现代医学占统治地位的医学模式仍然是
A. 神灵主义医学模式
B. 自然哲学医学模式
C. 机械论医学模式
D. 生物医学模式
E. 生物-心理-社会医学模式

正确答案：D。生物医学模式

解析：本题考查现代医学占统治地位的医学模式。现代医学占统治地位的医学模式仍然是生物医学模式（D对ABCE错），该模式是指从生物学角度认识健康与疾病，反映病因、宿主和自然环境三者内在联系的医学观和方法论。